在胃中（人体胃液pH值约为0.9～1.5）最容易被吸收的药物是
A. 奎宁（弱碱pKₐ=8.4）
B. 卡那霉素（弱碱pKₐ=7.2）
C. 地西泮（弱碱pKₐ=3.3）
D. 苯巴比妥（弱酸pKₐ=7.4）
E. 阿司匹林（弱酸pKₐ=3.5）

正确答案：D。苯巴比妥（弱酸pKₐ=7.4）

解析：本题考查药物的酸碱性对药效的影响。通常酸性药物在pH低的胃中，碱性药物在pH高的小肠中的非解离型药物量增加，吸收也增加，反之都减少。人体胃液pH值约为0.9～1.5，对于酸性药物来说lg[HA]/[A⁻]=PKa-PH，PKa越大，药物的分子型越多，越容易被吸收，苯巴比妥、阿司匹林（E错）比较容易吸收，相较而言苯巴比妥（D对）更容易吸收。奎宁（A错）、卡那霉素（B错）、地西泮（C错）为碱性药物，在pH较高的部位易被吸收。